治疗咳嗽，头虱应首选的药物是
A. 百部
B. 紫菀
C. 苦杏仁
D. 桑白皮
E. 葶苈子

正确答案：A。百部

解析：本题主要考查止咳平喘药的鉴别。百部具有润肺止咳，杀虫灭虱的功效，可以用于咳嗽、头虱（A对）。治疗头虱时可将其制成20%乙醇液，或50%水煎剂外搽。紫菀具有润肺化痰止咳的功效，可用于咳嗽有痰，凡咳嗽之证，无论外感、内伤，病程长短，寒热虚实，皆可用之（B错）。苦杏仁具有止咳平喘，润肠通便的功效，可用于咳嗽气喘，为治咳喘之要药；肠燥便秘；蛲虫病、外阴瘙痒（C错）。桑白皮具有泻肺平喘，利水消肿的功效，可用于肺热咳嗽和水肿（D错）。葶苈子具有泻肺平喘，利水消肿的功效，可用于痰涎壅盛，喘息不得平卧；水肿，悬饮，胸腹积水，小便不利（E错）。